治肝风内动、惊痫抽搐的药物是
A. 朱砂
B. 磁石
C. 两者均是
D. 两者均不是

正确答案：B。磁石

解析：本题考查的是磁石的主治病证。治肝风内动、惊痫抽搐的药物是磁石（B对）。磁石：【功效】镇惊安神，平肝潜阳，聪耳明目，纳气平喘。朱砂（A错）：【功效】镇心安神，清热解毒。